下列关于发展中国家与发达国家在各种伤害的发展趋势上表述错误的有
A. 发达国家的道路交通伤害有逐年下降的趋势
B. 发达国家的总体伤害死亡率下降不明显
C. 发达国家的职业性伤害有逐年下降的趋势
D. 发展中国家的道路交通伤害有逐年下降的趋势
E. 总体上发达国家的伤害死亡低于发展中国家

正确答案：D。发展中国家的道路交通伤害有逐年下降的趋势

解析：本题考查伤害的全球流行特征。发展中国家的道路交通伤害并没有呈逐年下降的趋势（D错，为本题正确答案），由上述图标反映得出道路交通伤害逐年下降的是大部分发达国家（A对）。总体上来说，发展中国家的伤害死亡率高于发达国家（E对），但发达国家的总体伤害死亡率下降不明显（B对）。发达国家的职业性伤害有逐年下降的趋势（C对）。